水解后可生成一分子的皂苷元和两分子的葡萄糖醛酸的化合物是
A. 甘草酸
B. 人参皂苷Rg₁
C. 三七皂苷R₁
D. 黄芪甲苷
E. 柴胡皂苷a

正确答案：A。甘草酸

解析：本题考查甘草的药理作用。甘草的药理作用：水乙醇或乙醚，但极易溶于稀氨水中，通常利用该性质提取甘草皂苷。甘草皂苷水溶液有微弱的起泡性和溶血性；甘草皂苷可以形成钾盐或钙盐形式，并存在于甘草中；甘草皂苷（A对）与5%的稀硫酸在加压、110℃～120℃条件下水解，可生成一分子的甘草皂苷元（甘草次酸）和两分子的葡萄糖醛酸。人参的药理作用：（1）增强免疫功能人参能提高免疫功能低下的动物巨噬细胞吞噬活性及NK细胞活性，提高抗原刺激小鼠的抗体水平。人参皂苷（B错）、人参多糖是人参提高免疫功能的有效成分。（2）增强学习记忆能力人参、人参皂苷对多种化学物造成的实验动物记忆获得、记忆巩固和记忆再现障碍均有改善作用。三七的药理作用：（1）止血三七具有较强的止血作用。三七粉、三七注射液、三七氨酸可缩短出血时间、凝血时间和凝血酶原时间，增加血小板数量和功能，增加凝血酶含量，促进纤维蛋白形成，收缩局部血管。（2）抗血栓三七、三七总皂苷可抑制血小板聚集，激活尿激酶，促进纤维蛋白溶解。（3）扩张血管，改善微循环三七皂苷可舒张血管，其中对冠状动脉的血管舒张作用最强，并具有一定的血管内皮依赖性。三七皂苷能改善肠系膜、冠状动脉、肝脏微循环。三七皂苷Rg1（C错）可改善耳廓微循环、脑微循环。黄芪的药理作用：黄芪具有增强免疫功能，强心，扩张外周血管、冠状血管及肾血管，改善微循环，抑制血小板聚集等作用。黄芪煎液、黄芪注射液等对机体免疫功能有显著促进作用，主要成分为黄芪多糖和黄芪甲苷（D错），并有促进造血干细胞分化和增殖的功能，促进骨髓造血的功能。柴胡的药理作用：（1）解热、镇痛、抗炎柴胡是治疗外感发热的要药，善于治疗寒热往来的半表半里之热。柴胡、柴胡挥发油及柴胡皂苷等对多种原因引起的动物实验性发热均有明显的解热作用。柴胡皂苷（E错）、皂苷元A和挥发油是柴胡解热的主要有效成分。柴胡煎剂、柴胡皂苷对多种实验性疼痛模型均有镇痛作用。柴胡水提物、柴胡粗皂苷、柴胡皂苷和柴胡挥发油有抗炎作用。